急性根尖周炎应急处理的主要原则是
A. 消炎止痛
B. 安抚治疗
C. 调（牙合）止痛
D. 建立引流
E. 开髓开放

正确答案：D。建立引流

解析：本题考查应急处理。急性根尖周炎应急处理的主要原则是建立引流（D对）。急性根尖炎只有建立根管的引流，减轻根管内压力才能缓解临床症状。仅开髓开放（E错）不够，一定要建立引流通道，才能缓解根尖部的压力，解除疼痛。消炎止痛（A错）一般可采用口服或注射的途径给予抗生素类药物或止痛药，也可以局部封闭、理疗及局部针灸止痛。安抚治疗（B错）是用具有抗菌消炎的药物使充血的牙髓恢复正常。调（牙合）止痛（C错）是指通过调（牙合）磨改使患牙咬合降低、功能减轻，得以休息，必要时局部封闭或理疗。消炎止痛、安抚治疗、调（牙合）止痛也是治疗根尖周病的方法，但非应急措施。